男，26岁。因人际关系问题而寻求心理治疗，被要求分享体验和自己的经验。这一心理治疗的方法属于
A. 精神分析法
B. 行为疗法
C. 以人为中心疗法
D. 催眠疗法
E. 认知疗法

正确答案：E。认知疗法

解析：心理治疗方法主要包括精神分析、行为疗法、认知疗法、以人为中心疗法、森田疗法、暗示和催眠疗法、家庭治疗等，认知疗法要求先识别与检验自动负性想法，然后识别与盘诘功能失调性假设，再制定行为计划，进一步检验原有假设，并巩固新的功能性假设，使其思维模式和信息加工过程得以矫正。患者因人际关系问题而寻求心理治疗，被要求分享体验和自己的经验，这是为了引出并识别患者想法的不合理处（即识别负性自动想法），应用的心理治疗方法是认知疗法（E对）。精神分析法（A错）认为来访者的心理障碍是由于压抑在潜意识中的某些幼年时期所受的分伤所致，治疗是通过自由联想、对梦的解析等方法，帮来访者将压抑在潜意识中的各种心理冲突，主要是幼年时期的精神创伤，释放到意识层面，使来访者产生顿悟，从而发生行为和情感上的改变。行为疗法（B错）是建立在行为学习理论基础上，依据条件反射学说和社会学习理论，以减轻或改善来访者的症状或不良行为为目标的心理治疗技术；它是通过分析确立病人的不良行为，循序渐进地给予一系列练习作业帮助病人改变不良行为，强调实践和自我练习。以人为中心疗法（C错）是为来访者创造一个使其自我发现、自我成长的环境和氛围，向其提供重新开始成长的机会和自由表达的空间，帮助来访者认识、理解正视真实的情绪和需求，使之从否定自己的情绪或有需求的状态转而接受自己，依靠自身的成长、成熟战胜不良情绪、行为。催眠疗法（D错）运用暗示的方法使患者进入一种特殊的意识状态，控制患者的心身活动，从而解除和治疗患者的心身问题，主要用于治疗各种神经症（如抑郁症、焦虑症、社交恐怖症、恐高症、癔症、失眠症等）、心身疾病、功能性疼痛、性功能障碍、心因性遗忘及嗜烟酒等不良行为。